洋地黄毒苷是
A. 强心苷
B. 腺苷
C. 吲哚苷
D. 鸟苷
E. 三萜皂苷

正确答案：A。强心苷

解析：本题考查的是洋地黄毒苷的分类。洋地黄毒苷是强心苷（A对）。洋地黄毒苷为强心苷，为三糖苷，在水中溶解度小，易溶于三氯甲烷。腺苷（B错）与鸟苷（D错）均属于氮苷。吲哚苷（C错）：如靛苷，其苷元吲哚醇无色，易氧化成蓝色的靛蓝。三萜皂苷（E错）是由三萜皂苷元和糖组成，苷元为三萜类化合物，其基本骨架由6个异戊二烯单位组成。